神经-骨骼肌接头处的化学递质是
A. 乙酰胆碱
B. 去甲肾上腺素
C. 肾上腺素
D. 5-羟色胺
E. 神经肽

正确答案：A。乙酰胆碱

解析：骨骼肌神经-肌肉接头由接头前膜-接触间隙-接头后膜（终板膜）组成。动作电位传到运动神经末梢引起接头前膜去极化，电压门控钙通道开放，Ca²⁺进入神经末梢，引起突触囊泡出胞、ACh（乙酰胆碱）（A对）释放，继而激活突触后膜N₂型ACh受体阳离子通道，终板膜对Na⁺、K⁺等通透性增高，终板膜去极化，产生终板电位，完成由化学信号到电信号的转导。肾上腺素（C错）和去甲肾上腺素（B错）为肾上腺素能神经元和去甲肾上腺素能神经元的递质，神经-骨骼肌接头处的神经元为胆碱能神经元，无此递质（P310）。5-羟色胺（D错）主要分布在血小板及胃肠道肠嗜铬样细胞和肌间神经丛（P311）。神经肽（E错）主要分布于神经系统，起信息传递或调节信息传递效率的作用（P312）。